朱砂的使用注意有
A. 忌火煅
B. 不宜过量服
C. 不宜久服
D. 心经有热者慎用
E. 肝肾功能异常者慎用

正确答案：A、B、C、E。忌火煅；不宜过量服；不宜久服；肝肾功能异常者慎用